结构式中含有亚砜基团，产生手性中心的药物有
A. 兰索拉唑
B. 西咪替丁
C. 法莫替丁
D. 泮妥拉唑
E. 雷贝拉唑

正确答案：A、D、E。兰索拉唑；泮妥拉唑；雷贝拉唑